动脉瘤性动眼神经麻痹的临床表现是
A. 眼裂正常，瞳孔扩大，直接对光反射迟钝
B. 眼裂扩大，瞳孔缩小，直接对光反射正常
C. 眼裂变小，瞳孔缩小，直接对光反射正常
D. 眼裂变小，瞳孔正常，直接对光反射正常
E. 眼裂变小，瞳孔扩大，直接对光反射消失

正确答案：E。眼裂变小，瞳孔扩大，直接对光反射消失

解析：动眼神经支配上睑提肌，使瞳孔缩小，当发生动脉瘤性动眼神经麻痹时，眼裂变小（AB错），瞳孔扩大（BCD错），直接对光反射消失（E对）。